女童，7岁，乳牙龋坏较多，已充填。六龄牙已萌齐，医生诊断16（牙合）面中龋，采用龋非创伤性充填（ART）治疗该牙该儿童16牙釉质开口小，医生使用扩大窝洞口的器械是
A. 探针
B. 镊子
C. 挖匙
D. 斧形器
E. 雕刻刀

正确答案：D。斧形器

解析：本题考查非创伤性修复治疗。牙用手斧（D对）或锄形器：扩展洞形，用于进一步扩大洞口使挖器易于进入。